张某因听力下降，决定去某药品零售企业购买一台助听器。选购时发现不同助听器的注册证号具有不同的格式：国械注进2015246××××号，沪食药监械（准）2012第246××××，京药监械（准）2012第246××××等，为此专门请教该药品零售企业值班药师，并购买了其中一款，使用两天后，张某发现该助听器存在质量问题，遂到该药店要求退货。如果该零售药店不同意退货与张某发生争议，下列关于双方解决争议的方式中，错误的是
A. 向卫生行政部门投诉
B. 继续和张某协商
C. 请求消费者权益保护协会调解
D. 向人民法院提起诉讼

正确答案：A。向卫生行政部门投诉

解析：本题考查消费者与经营者争议的解决。张某因听力下降，决定去某药品零售企业购买一台助听器。选购时发现不同助听器的注册证号具有不同的格式：国械注进2015246××××号，沪食药监械（准）2012第246××××，京药监械（准）2012第246××××等，为此专门请教该药品零售企业值班药师，并购买了其中一款，使用两天后，张某发现该助听器存在质量问题，遂到该药店要求退货。如果该零售药店不同意退货与张某发生争议，应向有关行政部门投诉（A错，为本题正确答案）。《中华人民共和国消费者权益保护法》第六章争议的解决第三十九条：消费者和经营者发生消费者权益争议的，可以通过下列途径解决：（一）与经营者协商和解（B对）；（二）请求消费者协会或者依法成立的其他调解组织调解（C对）；（三）向有关行政部门投诉；（四）根据与经营者达成的仲裁协议提请仲裁机构仲裁；（五）向人民法院提起诉讼（D对）。